结核病死亡位居传染病死亡
A. 第一位
B. 第二位
C. 第三位
D. 第四位
E. 第五位

正确答案：B。第二位